妥布霉素对铜绿假单胞菌的作用是庆大霉素的
A. 1～3倍
B. 2～4倍
C. 2～5倍
D. 3～5倍
E. 以上均不正确

正确答案：C。2～5倍

解析：妥布霉素的临床应用：对铜绿假单胞菌的作用是庆大霉素的2～5倍，且对耐庆大霉素菌株仍有效，适合治疗铜绿假单胞菌所致的各种感染，通常应与能抗铜绿假单胞菌的青霉素类或头孢菌素类药物合用。掌握“氨基糖苷类抗生素”知识点。